疑核发出纤维支配
A. 咀嚼肌
B. 眼球外肌
C. 咽喉肌
D. 胸锁乳突肌
E. 斜方肌

正确答案：C。咽喉肌

解析：疑核发出特殊内脏运动纤维支配咽喉肌（C对）。咀嚼肌（A错）是由三叉神经运动核发出特殊内脏运动纤维支配的。眼球外肌（B错）是由动眼、滑车、展神经核发出一般躯体运动纤维支配的。胸锁乳突肌（D错）、斜方肌（E错）是由副神经核发出特殊内脏运动纤维支配的。